土壤气型污染的特点之一是
A. 污染物主要在土壤深层
B. 污染物集中在土壤表层
C. 污染物在土壤中均匀分布在各层
D. 污染物在土壤中浓度与大气中浓度无关
E. 污染物在土壤中分布不受气象因素影响

正确答案：B。污染物集中在土壤表层

解析：本题考查土壤气型污染的特点。气型污染是由于大气中污染物沉降至地面而污染土壤（B对ACD错）。主要污染物有铅、镉、砷、氟等，例如大型冶炼厂排放含氟的污染物落到附近土壤中。气型污染分布的特点和范围受大气污染源性质的影响（如点源和面源及排放方式的不同），也受气象因素影响（E错），其污染范围和方向各不相同。